既能杀虫，又能润肺止咳的药物是
A. 贯众
B. 槟榔
C. 花椒
D. 雷丸
E. 榧子

正确答案：E。榧子

解析：该题考查榧子的功效。榧子味甘，性平，归肺、胃、大肠经。其功效为杀虫消积，润肠通便，润肺止咳（E对）。